有关涂膜剂的不正确表述是
A. 是一种可涂布成膜的外用胶体溶液制剂
B. 使用方便
C. 处方由药物、成膜材料和蒸馏水组成
D. 制备工艺简单，无需特殊机械设备
E. 常用的成膜材料有聚乙烯缩丁醛和火棉胶等

正确答案：C。处方由药物、成膜材料和蒸馏水组成

解析：本题考查涂膜剂。处方由药物、成膜材料、挥发性有机溶剂组成（C错，为本题正确答案）。涂膜剂是一种可涂布成膜的外用胶体溶液制剂（A对），使用方便（B对）；制备工艺简单，无需特殊机械设备（D对）；常用的成膜材料有聚乙烯缩丁醛和火棉胶等（E对）。